在分析食物中毒暴发的可能原因时，适合采用的指标是
A. 发病率
B. 患病率
C. 死亡率
D. 罹患率
E. 续发率

正确答案：D。罹患率

解析：本题考查罹患率。罹患率（D对ABCE错）是测量某人群某病新病例发生频率的指标，通常指在某一局限范围短时间内的发病率。适用于局部地区疾病的爆发，如食物中毒、传染病及职业中毒等爆发流行情况。